妊娠13周，无不适，体查子宫耻骨联合上未扪及，胎心未闻及，胚胎如8周大小，最可能的诊断是
A. 难免流产
B. 不全流产
C. 流产合并感染
D. 先兆流产
E. 稽留流产

正确答案：E。稽留流产

解析：妊娠13周，无不适，体查子宫耻骨联合上未扪及，胎心未闻及，胚胎如8周大小（稽留流产子宫小于停经周数，但大于正常非孕子宫），最可能诊断为稽留流产（E对）。先兆流产（D错）指妊娠28周前出现少量阴道流血，常为暗红色或血性白带，无妊娠物排出，随后出现阵发性下腹痛或腰背痛，妇科检查宫口未开，胎膜未破，子宫大小与停经周数相符。难免流产（A错）在先兆流产的基础上，阴道流血量增多，阵发性下腹痛加剧，或出现阴道流液，妇科检查宫颈口已扩张，有时可见胚胎组织或胎囊堵塞于宫颈内口，子宫大小与停经周数基本相符或略小。不全流产（B错）是指妊娠物未全部排出。流产感染（C错）常因阴道流血时间长，有组织残留于宫腔内或非法堕胎，可表现为盆腔炎、腹膜炎、败血症及感染性休克。